治疗血虚之眩晕，心悸，月经不调，崩漏应首选
A. 当归
B. 熟地黄
C. 白芍
D. 阿胶
E. 何首乌

正确答案：B。熟地黄

解析：熟地黄甘温质润，补阴益精以生血，为治疗血虚证之要药，用治血虚萎黄，眩晕，心悸失眠，月经不调，崩漏等（B对）。当归（A错）长于补血，为补血的圣药，善治血虚萎黄，心悸失眠，月经不调。白芍（C错）偏补益肝之阴血，用治血虚萎黄，眩晕，心悸，月经不调，崩中漏下。阿胶（D错）为血肉有情之品，甘温质润，为补血要药，尤善治出血而致血虚者。制何首乌（E错）善治血虚萎黄，失眠健忘，须发早白，肾虚无子等。